下列物质都可破坏臭氧层，除了
A. CCl₄
B. CFCs
C. N₂O
D. CO₂
E. 哈龙类物质

正确答案：D。CO₂

解析：本题考查臭氧层破坏。消耗臭氧的物质主要有N₂O（C对）、CCl₄（A对）、CH₄ 、溴氟烷烃类（哈龙类，Halons）（D对）以及CFC（B对）等。CO₂（D错，为本题正确答案）不会破坏臭氧层。